支配胸锁乳突肌运动
A. 颈横神经
B. 副神经
C. 三叉神经
D. 枕小神经
E. 面神经

正确答案：B。副神经

解析：颈横神经（A错）主要分布于颈前部皮肤。副神经（B对）主要支配胸锁乳突肌和斜方肌。三叉神经（C错）主要传导咀嚼肌和眼外肌的本体感觉以及面部皮肤、眼及眶内、口腔、鼻腔、鼻旁窦的黏膜、牙齿、脑膜等，传导痛、温、触等浅感觉。枕小神经（D错）分布于枕部及耳郭背面上部的皮肤。面神经（E错）主要支配面部表情肌及舌前2/3的味觉。